下列关于乳牙的髓腔形态的叙述中，不正确的是
A. 与乳牙的外形相似
B. 但按牙体比例而言，乳牙髓腔较恒牙者为大
C. 乳牙的髓腔髓室大、髓壁薄
D. 乳牙的髓腔髓角高、根管粗
E. 乳牙的髓腔根管斜度较小

正确答案：E。乳牙的髓腔根管斜度较小

解析：本题考查恒磨牙髓腔形态及乳恒牙髓腔临床意义。乳牙的髓腔根管斜度较小（E错，为本题正确答案）不符合乳牙的髓腔形态。乳牙的髓腔形态：虽与乳牙的外形相似（A对），但按牙体比例而言，乳牙髓腔较恒牙者为大（B对），表现为髓室大、髓壁薄（C对）、髓角高、根管粗（D对）、根管斜度较大，根尖孔亦大。故在制备洞形时，应注意保护牙髓，防止穿髓。